一侧胸腔积液的表现是
A. 肺野大片致密，胸廓塌陷，纵隔向患侧移位
B. 肺野大片致密，肋间隙增宽，纵隔向健侧移位
C. 肺纹理增多增粗紊乱
D. 肺野透亮度增加
E. 一侧肺野团块状阴影

正确答案：B。肺野大片致密，肋间隙增宽，纵隔向健侧移位

解析：一侧胸腔积液的表现是肺野大片致密，呈均匀致密阴影，肋间隙增宽，纵隔向健侧移位（B对）。一侧肺不张的表现是肺野大片致密，胸廓塌陷，纵隔向患侧移位（A错）。肺纹理增多增粗紊乱见于肺部炎症（C错）。肺野透亮度增加见于肺气肿、肺大疱（D错）。一侧肺野团块状阴影考虑肺部肿瘤（E错）。